上皮组织分化的肿瘤是
A. 颈部淋巴管瘤
B. 皮肤恶性黑色素瘤
C. 乳腺髓样癌
D. 子宫绒毛膜癌
E. 睾丸精原细胞瘤

正确答案：C。乳腺髓样癌

解析：腺癌是腺上皮的恶性肿瘤。腺癌较多见于胃肠道、肺、乳腺、女性生殖系统等。乳腺髓样癌（C对）是上皮组织分化的肿瘤。颈部淋巴管瘤（A错）为间叶组织来源的肿瘤（P113）；皮肤恶性黑色素瘤（B错）为神经外胚叶肿瘤（P117）；子宫绒毛膜癌（D错）是源自妊娠绒毛滋养层上皮的高度侵袭性恶性肿瘤，少数可发生于性腺或其他组织的多潜能细胞（P287-P288）。睾丸精原细胞瘤（E错）为生殖细胞肿瘤。